男，26岁。发现高血压2年。查体：双上肢血压180/100mmHg，双下肢血压140/80mmHg，BMI20，腰围80cm。正力体型。心尖区可闻及2/6级收缩期杂音，肩胛间区可闻及血管杂音，余瓣膜区未闻及杂音。该患者最可能的诊断是
A. 嗜铬细胞瘤
B. 皮质醇增多症
C. 原发性醛固酮增多症
D. 主动脉缩窄
E. 肾动脉狭窄

正确答案：D。主动脉缩窄

解析：患者青年男性，高血压1年，查体：双上肢血压180/100mmHg，双下肢血压140/80mmHg，肩胛间区可闻及血管杂音，患者症状体征与主动脉缩窄相符，故该患者最可能的诊断为主动脉缩窄（D对）。嗜铬细胞瘤（P260）（A错）典型表现为阵发性血压升高伴心动过速、头痛、出汗、面色苍白；皮质醇增多症（B错）多伴有向心性肥胖、满月脸、水牛背、皮肤紫纹、毛发增多、血糖增高等表现；原发性醛固酮增多症（C错）临床以长期高血压伴低血钾为特征，可有肌无力、周期性瘫痪、烦渴、多尿等症状；肾动脉狭窄（E错）多可在上腹部或背部肋脊角处闻及杂音，这四种病不会出现上下肢血压出现明显差异等症状。